属于第二类精神药品的是
A. 氨酚待因片
B. 氨酚氢可酮片
C. 氢可酮
D. 氯胺酮

正确答案：B。氨酚氢可酮片

解析：本题考查精神药品目录。属于第二类精神药品的是氨酚氢可酮片（B对）。目前，目录确定的我国生产及使用的第二类精神药品有28个品种，具体有以下品种。1.异戊巴比妥2.格鲁米特3.喷他佐辛4.戊巴比妥5.阿普唑仑6.巴比妥7.氯硝西泮8.地西泮9.艾司唑仑10.氟西泮11.劳拉西泮12.甲丙氨酯13.咪达唑仑14.硝西泮15.奥沙西泮16.匹莫林17.苯巴比妥18.唑吡坦19.丁丙诺啡透皮贴剂20.布托啡诺及其注射剂21.咖啡因22.安钠咖23.地佐辛及其注射剂24.麦角胺咖啡因片25.氨酚氢可酮片26.曲马多27.扎来普隆28.佐匹克隆。氨酚待因片（A错）为含特殊药品复方制剂。氢可酮（C错）为麻醉药品。氯胺酮（D错）为第一类精神药品。